下述情况能导致肾小球滤过率减少的是
A. 血浆胶体渗透压下降
B. 血浆胶体渗透压升高
C. 血浆晶体渗透压下降
D. 血浆晶体渗透压升高
E. 肾小球毛细血管血压升高

正确答案：B。血浆胶体渗透压升高

解析：由于囊内液胶体渗透压接近于0mmHg，所以肾小球有效滤过压＝肾小球毛细血管静水压－血浆胶体渗透压－肾小囊内压，由此可知当血浆胶体渗透压升高时，肾小球有效滤过压降低，导致肾小球滤过率减少（B对）。当血浆胶体渗透压下降（A错）时，肾小球有效滤过压升高，导致肾小球滤过率升高。肾小球滤过压与血浆晶体渗透压无关（CD错）。肾小球毛细血管压升高（E错），则肾小球有效滤过压升高，滤过率增高。